下列疾病，蜘蛛痣有诊断意义的是
A. 肝硬化
B. 麻疹
C. 猩红热
D. 伤寒
E. 药物过敏

正确答案：A。肝硬化

解析：蜘蛛痣有诊断意义的是肝硬化（A对），与肝脏对雌激素灭活作用减弱有关，肝硬化患者肝功能受损，对雌激素灭活作用减弱或消失。麻疹（B错）、药物过敏（E错）患者皮肤出现丘疹。猩红热（C错）患者皮肤出现斑丘疹。伤寒（D错）患者皮肤出现玫瑰疹。